需要通过重组修复的DNA损伤类型
A. 插入
B. 缺失
C. 点突变
D. 双链断裂
E. 倒位或转位

正确答案：D。双链断裂

解析：重组修复是指依靠重组酶系，将另一段未受损伤的DNA移到损伤部位，提供正确的模板，进行修复的过程。双链断裂（D对）修复没有互补链提供修复断裂的遗传信息，因此需要进行重组修复。碱基插入（A错）、缺失（B错）和点突变（C错）只需要碱基错配修复来进行修复。倒位或转位（E错）有互补链提供修复的遗传信息，不需要通过重组修复。